患者，男，54岁。患糖尿病14年，面色晦暗，消瘦乏力，胸中闷痛，肢体麻木刺痛，夜间尤甚，唇紫，舌暗，脉弦。治疗应首选
A. 桃核承气汤
B. 补阳还五汤
C. 通窍逐瘀汤
D. 桃红四物汤
E. 当归四逆汤

正确答案：D。桃红四物汤

解析：患者患糖尿病14年，瘀血凝滞，脉络不通，故见面色晦暗，胸中闷痛，肢体麻木刺痛，夜间尤甚；痰结于胸，故胸中闷痛；唇紫，舌暗，脉弦为痰瘀互结之侯。治疗应活血化瘀祛痰，方药选用平胃散合桃红四物汤加减（D对）。桃核承气汤（A错）可以逐瘀泻热，用于治疗下焦蓄血证。补阳还五汤（B错）可以补气、活血、通络，用于治疗中风之气虚血瘀证半身不遂，口眼涡斜，语言不利。通窍逐瘀汤（C错）可以活血通窍，用于治疗头面瘀阻证。当归四逆汤（E错）可以温经散寒，养血通脉，用于治疗血虚寒凝经脉证。